佝偻病患儿3～6个月时出现
A. 颅骨软化
B. 出牙延迟
C. 方颅
D. 前囟增大
E. 胸廓畸形

正确答案：A。颅骨软化

解析：颅骨软化是佝偻病最早出现的骨骼改变，常见于3～6个月的婴儿（A对）。出牙延迟是维生素D缺乏性佝偻病的表现，具体表现为乳牙萌出延迟，可迟至10个月甚至1岁多方出牙，3岁才出齐（B错）。方颅常见于7～8个月婴儿，故9～10个月婴儿可见方颅畸形（C错）。前囟出生时约1～2cm，以后随着颅骨生长而增大，6月龄左右逐渐骨化而变小。这是正常规律，佝偻病对前囟的大小无明显影响（D错）。胸廓畸形分为肋骨串珠、鸡胸和漏斗胸，多见于1岁左右小儿（E错）。